使心跳减慢的植物性神经纤维来自
A. 肋间神经
B. 膈神经
C. 迷走神经
D. 交感神经
E. 以上都不是

正确答案：C。迷走神经

解析：使心跳减慢的植物性神经纤维来自迷走神经（C对），交感神经（D错）兴奋则会导致心跳加快。肋间神经（A错）的功能为支配胸固有肌如肋间内、外肌运动。膈神经（B错）的功能为支配膈肌运动。